上消化道出血最常见的病因是
A. 肝硬化食道静脉曲张破裂
B. 食管贲门粘膜撕裂综合征
C. 消化性溃疡
D. 胆道出血
E. 胃癌

正确答案：C。消化性溃疡

解析：上消化道出血可见于消化性溃疡、肝硬化食道静脉曲张破裂（A错）、急性糜烂性出血性胃炎、食管贲门黏膜撕裂综合征（B错）、胆道出血（D错）、胃癌（E错）等。其中消化性溃疡（C对）是上消化道出血最常见的病因，约占所有病因中的50%。需要注意的是肝硬化最常见的并发症是上消化道出血，其中以食管胃底静脉曲张破裂最常见，但上消化道出血最常见的病因是消化性溃疡。